蜡样屈曲多见于
A. 神经症
B. 精神分裂
C. 反应性精神障碍
D. 抑郁症
E. 躁狂症

正确答案：B。精神分裂